母乳中所含乳糖和脂肪最少的时间是
A. 产后第1周
B. 产后第2周
C. 产后第3周
D. 产后第4周
E. 产后第5周

正确答案：A。产后第1周